下列除哪项外，均为阳明腑实证的临床表现
A. 脉沉迟而实
B. 日晡潮热
C. 身热不扬
D. 腹胀拒按
E. 大便秘结

正确答案：C。身热不扬

解析：身热不扬，多因湿邪困阻，热难透达，湿遏热伏所致，故属湿温潮热非阳明腑实证（C对）。阳明腑证是指邪热与肠中糟粕相搏，燥屎内结，腑气不通所表现的证候。脉沉迟而实多因燥热内结于肠，肠道壅滞所致（A错）。日晡潮热多因阳明经气旺于日晡，实热弥漫于经所致（B错）。腹胀拒按，大便秘结均多因邪热与糟粕互结肠中，腑气闭阻不通所致（DE错）。